将氟尿嘧啶制成去氧氟尿苷的目的是
A. 延长药物的作用时间
B. 增加药物对特定部分作用的选择性
C. 改善药物的溶解性能
D. 提高药物的稳定性
E. 改善药物的吸收性

正确答案：B。增加药物对特定部分作用的选择性

解析：本题考查嘧啶类抗代谢物。去氧氟尿苷是氟尿嘧啶类衍生物，在肿瘤组织中转化成5-氟尿嘧啶发挥选择性抗肿瘤作用。（B对ACDE错）。